一位临产孕妇，突感头痛，恶心，相继发生抽搐，查血压为160/110mmHg，下肢水肿。对此病人最适用哪种抗惊厥药
A. 地西泮
B. 水合氯醛
C. 苯巴比妥钠
D. 硫酸镁
E. 硫喷妥钠

正确答案：D。硫酸镁